机体在一定时间内，对定量食物咀嚼磨细的程度，称为
A. 咀嚼周期
B. 咀嚼效率
C. 咀嚼肌力
D. （牙合）力
E. 牙周潜力

正确答案：B。咀嚼效率

解析：机体在一定时间内，对定量食物咀嚼磨细的程度，称为咀嚼效率。掌握“咀嚼过程、类型，咀嚼周期及生物力”知识点。